诊断风湿活动期最有价值的是
A. 类风湿因子阳性
B. 血沉增快
C. 补体C₃增高
D. 白胞计数减少
E. 血常规正常

正确答案：B。血沉增快

解析：血沉与病情活动度相关，血沉增快，说明病情处于活动期，变化快，是诊断风湿活动期最有价值的（B对）。诊断类风湿性关节炎最具有价值的是类风湿因子阳性（A错）。补体C3增高见于急性炎症（C错）。关节有炎症时滑液增多，滑液中的白细胞数明显升高（DE错）。